有机磷引起中毒的机制是
A. 直接激动胆碱受体
B. 持久地抑制腺苷环化酶
C. 持久地抑制磷酸二酯酶
D. 持久地抑制胆碱酯酶
E. 持久地抑制单胺氧化酶

正确答案：D。持久地抑制胆碱酯酶